产前筛查先天畸形的主要手段之一是
A. 超声检查
B. 羊水染色体检查
C. 普通孕妇检查
D. 生化检测检查
E. 传染病筛查

正确答案：A。超声检查

解析：本题考查产前筛查。产前筛查是防止出生缺陷的重要步骤，常用的方法有：超声检查、绒毛活检、羊膜腔胎儿造影、胎儿镜检查、胎儿心动图、羊膜腔穿刺行羊水检查等。其中产前筛查先天畸形的主要手段之一是超声检查（A对）。羊水染色体检查（B错）是经羊膜腔穿刺取羊水进行羊水成分分析的—种出生前的诊断方法；应用羊水细胞可以进行判断胎儿性别、羊水细胞培养行染色体核型分析、酶的分析、宫内感染病原体检测胎儿血型判断等；目前常用于胎儿肺成熟度判断、宫内感染病原体检测和产前诊断。普通孕妇检查（C错）即产前检查与保健，包括对孕妇的定期产前检查、指导妊娠期营养和用药、及时发现和处理异常情况，对胎儿宫内情况进行监护、保证孕妇和胎儿的健康直至安全分娩。生化检测检查（D错）、传染病筛查（E错）均属于产前检查的项目。